低钾血症对心肌功能的损害可表现有
A. 窦性心动过速
B. 期前收缩
C. 阵发性心动过速
D. 对洋地黄类药物毒性的敏感性增高
E. 以上都是

正确答案：E。以上都是

解析：低钾血症时心肌兴奋性升高，传导性降低，自律性升高，收缩性升高。自律性增高可导致窦性心动过速（A对），自律性升高可能导致异位起搏而出现期前收缩（B对）、阵发性心动过速（C对），低钾血症时，洋地黄与Na⁺-K⁺-ATP酶的亲和力增高而增强了洋地黄的毒性作用（D对，故E为本题正确答案），并显著降低其治疗的效果。